人体试验必须坚持的原则中，不正确的是
A. 知情同意原则
B. 经济利益原则
C. 科学对照原则
D. 医学目的原则
E. 维护病人利益原则

正确答案：B。经济利益原则

解析：人体试验是医学科学发展的基础和前提，人体试验不以经济利益为原则（B错，为本题正确答案）。在生物医学研究中，尊重人的核心问题就是尊重受试者自主权或知情同意权，是保障受试者权益的基础（A对）。试验设对照组进行对照试验的目的是为了比较新药与对照药物两组治疗结果的差别有无统计学显著意义（C对）。人体试验对于促进医学科学的发展、维护人类自身利益，具有极其重要的意义（DE对）。